作用为增强吞噬细胞的吞噬细菌的是
A. 穿越胎盘
B. 调理吞噬
C. 穿越黏膜
D. 介导细胞杀伤
E. 介导Ⅰ型超敏反应

正确答案：B。调理吞噬

解析：调理吞噬：IgG（IgG1和IgG3）与细菌等结合后，可通过其Fc段与巨噬细胞和中性粒细胞表面的IgGFc受体结合，通过IgGFc段的“桥联”作用，增强吞噬细胞的吞噬细菌作用。掌握“免疫球蛋白的类型及功能”知识点。